一位心理学专家为了对一名3岁幼儿作心理评估，去孩子所在的幼儿园观看该幼儿在游戏中的表现，这种心理评估的方法是
A. 现状调查法
B. 自由式会谈法
C. 控制观察法
D. 自然观察法
E. 心理测验法

正确答案：D。自然观察法